关于尊重原则，正确的是
A. 尊重原则不包括尊重那些没到法定年龄的人和他们的决定
B. 尊重原则是指尊重那些值得尊重的人和他们的决定
C. 尊重原则是指尊重所有的人和他们的决定
D. 尊重原则也包括尊重那些没到法定年龄的人，有时甚至还包括他们的有些决定
E. 尊重原则与有利原则冲突时，绝对要以尊重原则为主

正确答案：D。尊重原则也包括尊重那些没到法定年龄的人，有时甚至还包括他们的有些决定

解析：本题考查尊重原则。关于尊重原则正确的是尊重原则也包括尊重那些没到法定年龄的人，有时甚至还包括他们的有些决定（D对）。尊重原则也包括尊重那些没到法定年龄的人（A错），有时甚至还包括他们的有些决定；尊重原则是指尊重所有的人和他们的合理的决定（BC错）；尊重原则与有利原则冲突时，可以根据患方错误决策可能导致的严重后果的不同情况，适当行使劝导、限制、干涉等“家长权”；医方尊重病人自主权，绝不意味着放弃或者减轻自己的道德责任，也不意味着完全听命于病人或家属的错误意愿和要求，而是要充分考虑病人利益，积极承担医生应尽的责任，要对利害得失全面衡量，选择受益最大、伤害最小的医学决策（E错）。